孕34周，血压160/110mmHg，尿蛋白5g/24h，上腹痛，头晕眼花，应诊断为
A. 妊娠高血压病
B. 重度子痫前期
C. 中度妊高征
D. 妊娠合并肝炎
E. 妊娠合并慢性肾炎

正确答案：B。重度子痫前期

解析：妊娠期高血压疾病重度子痫前期：①BP收缩压≥160或舒张压≥110mmHg；②尿蛋白＞5.0g/24h或随机尿蛋白≥（+++）；至少伴有③持续性头痛或视觉障碍，或④持续性上腹疼痛，肝包膜下血肿或肝破裂症状，或⑤血小板低于正常值，或⑥血清肌酐≥106μmol/L，少尿，或⑦转氨酶升高，或⑧心力衰竭、肺水肿，或⑨低蛋白血症伴胸、腹腔积液。掌握“娠期高血压疾病”知识点。